女，38岁，人工流产术后2年出现痛经。进行性加重，需服用止痛药物，妇科检查子宫后倾屈，如妊娠50天大小，呈球状，质硬，活动受限。B超检查示子宫肌层回声不均匀，局部有短线状增强。最可能的诊断是
A. 盆腔结核
B. 子宫内膜炎
C. 慢性盆腔炎
D. 子宫腺肌病
E. 子宫肌瘤

正确答案：D。子宫腺肌病

解析：该患者人工流产术后出现痛经，进行性加重（子宫腺肌病主要症状是经量增多、经期延长和逐渐加重的进行性痛经）。妇检：子宫后倾屈，增大呈球状，质硬，活动受限（妇科检查子宫均匀增大或局限性隆起、质硬且有压痛）。B超检查示子宫肌层回声不均匀，局部有短线状增强，最可能的诊断是子宫腺肌病（D对）。盆腔结核（P265）（A错）表现为不孕、月经失调，下腹坠痛、发热盗汗等全身症状。子宫内膜炎（P261）（B错）、慢性盆腔炎（P261）（C错）表现为下腹痛、阴道分泌物增多，均无进行性痛经、子宫增大等症状。子宫肌瘤（P311）（E错）表现为经量增多及经期延长，子宫增大，无进行性痛经。